氰化物抑制生物氧化使组织利用氧能力减弱的机制是
A. 与还原型细胞色素氧化酶的Fe2+结合
B. 与氧化型细胞色素氧化酶的Fe3+结合
C. 增高线粒体内膜对H+的通透性
D. 抑制ATP合成酶的活性
E. 抑制丙酮酸氧化酶

正确答案：B。与氧化型细胞色素氧化酶的Fe3+结合

解析：任何影响线粒体电子传递或氧化磷酸化的因素都可引起组织性缺氧。氰化物中毒时，CN¯与氧化型细胞色素氧化酶的Fe3+结合（B对），使细胞色素氧化酶不能还原，失去传递电子的功能，呼吸链中断，生物氧化受阻，从而使组织利用氧的能力减弱。与还原型细胞色素氧化酶的Fe2+结合（A错）、增高线粒体内膜对H+的通透性（C错）、抑制ATP合成酶的活性（D错）、抑制丙酮酸氧化酶（E错）都不是氰化物抑制生物氧化使组织利用氧能力减弱的机制。